5岁患儿，8月15日开始发热，伴头痛恶心呕吐一次，次日稀便三次，精神不振，抽搐一次。体检：急性热病容，嗜睡状，颈强（+），克氏征（++），血常规检查：WBC15.0×10⁹/L，脑脊液为无色透明，白细胞数100×10⁹/L，中性80%。该患儿住院二天后，高热不退，反复抽搐，意识不清，呼吸节律不规整，双侧瞳孔不等大，此时重要的抢救措施是立即应用
A. 脱水剂
B. 呼吸兴奋剂
C. 地塞米松
D. 退热剂
E. 镇静剂

正确答案：A。脱水剂

解析：此时重要的抢救措施是立即应用脱水剂的原因为：患儿出现头痛、恶心和呕吐，意识不清及抽搐强直，应考虑脑水肿所致的颅内压增高（A对），双侧瞳孔不等大提示发生脑疝，故应当立即应用脱水剂。患儿没有出现中枢性呼吸衰竭的表现，故不使用呼吸兴奋剂（B错）。患儿双侧瞳孔不等大提示发生脑疝，处理原则是快速静脉输注高渗降颅内压药物，以缓解病情，争取时间，故此时立即应用地塞米松（C错）、退热剂（D错）、镇静剂（E错）是不正确的。